女性，19岁。近二周来发热38℃左右，伴恶心、呕吐、腹泻。遂出现心悸、胸痛、呼吸困难，晕厥发作。体检发现：面色苍白，精神萎糜。心率40次/分，律齐，心尖部第一心音低钝，且可闻及大炮音。临床诊断病毒性心肌炎。心电图表现最可能是
A. 窦性心动过缓
B. 一度房室传导阻滞
C. 二度房室传导阻滞
D. 三度房室传导阻滞
E. 室内传导阻滞

正确答案：D。三度房室传导阻滞

解析：正常情况下，心室收缩落在心房收缩之后，若心房和心室几乎同时收缩，第一心音增强，称为大炮音，常见于完全性（三度）房室传导阻滞、房颤（八版诊断学P154）。本例患者年轻女性，病毒性心肌炎诊断明确，心尖部第一心音低钝，心率40次/分且律齐（正常值60～100次/分，显著缓慢而规律），因此心电图表现最可能是三度房室传导阻滞（D对）。窦性心动过缓（A错）、一度房室传导阻滞（B错）、二度房室传导阻滞（C错）及室内传导阻滞（E错）均不会出现心房和心室同时收缩，一般不会闻及大炮音。